《药品生产监督管理办法（试行）》规定，药品委托生产的受托方应
A. 持有与生产该药品相符的《药品生产许可证》
B. 具有与生产该药品相适应的生产和质量保证条件
C. 取得该药品批准文号
D. 负责药品的销售
E. 持有与生产该药品相符的《药品GMP证书》

正确答案：A、B、E。持有与生产该药品相符的《药品生产许可证》；具有与生产该药品相适应的生产和质量保证条件；持有与生产该药品相符的《药品GMP证书》

解析：本题考查药品委托生产的受托方。《药品生产监督管理办法（试行）》规定，药品委托生产的受托方应持有与生产该药品相符的《药品生产许可证》（A对）；具有与生产该药品相适应的生产和质量保证条件（B对）；持有与生产该药品相符的《药品GMP证书》（E对）。依据《药品管理法》第十三条规定，接受委托生产药品的，受托方必须是持有与其受托生产的药品相适应的《药品生产质量管理规范》认证证书的药品生产企业。受托方应当严格执行质量协议，有效控制生产过程，确保委托生产药品及其生产符合注册和《药品生产质量管理规范》的要求，持有与生产该药品相符的《药品生产许可证》。